休克早期动脉血压变化的特点是
A. 升高
B. 降低
C. 正常或略降
D. 先降后升
E. 先升后降

正确答案：C。正常或略降

解析：休克早期即微循环缺血期，该期患者如果没有大失血，血压也可略降，后因代偿作用可正常或轻度升高（C对ABDE错），但是脉压会明显缩小，患者脏器有效灌流量明显减少。